针刺肌肉浅薄部位的腧穴，常用的进针法是
A. 指切
B. 挟持
C. 舒张
D. 提捏
E. 套管

正确答案：D。提捏

解析：进针法分为单手进针法、双手进针法、针管进针法。双手进针法分为指切进针法、夹持进针法、舒张进针法、提捏进针法、弹针速刺法。其中，提捏进针法（D对）适用于肌肉浅薄部位。指切（A错）适用于短针的进针，夹持（B错）适用于长针的进针，舒张（C错）适用于皮肤松弛部位腧穴的进针，套管（E错）可以代替押手，用于较短毫针的进针。